合成甘油磷脂的原料除外的是
A. 甘油
B. 磷脂
C. 脂肪酸
D. 磷酸盐
E. 胆碱

正确答案：B。磷脂

解析：合成甘油磷脂需甘油、脂肪酸、磷酸盐、胆碱、丝氨酸、肌醇等为原料。掌握“甘油磷脂、胆固醇和血脂蛋白代谢”知识点。